《麻醉药品、第一类精神药品运输证明》的有效期是
A. 3个月
B. 1年
C. 5年
D. 3年

正确答案：B。1年

解析：本题考查麻醉药品和精神药品运输管理。《麻醉药品、第一类精神药品运输证明》的有效期是1年（B对）。托运或自行运输麻醉药品和第一类精神药品的单位，应当向所在地设区的市级药品监督管理部门申请领取《麻醉药品、第一类精神药品运输证明》（简称运输证明）。运输第二类精神药品无需办理运输证明。（1）运输证明有正本和副本，正本1份，副本可根据实际需要申领若干份，必要时可增领副本。（2）运输证明有效期为1年（不跨年度）。运输证明应当由专人保管，不得涂改、转让、转借。有效期为3个月（A错）的是《药品类易制毒化学品购用证明》。《药品类易制毒化学品购用证明》由国家药品监督管理部门统一印制，有效期为3个月。有效期为5年（C错）的是《药品经营许可证》。药品经营许可证分为正本和副本，有效期为5年。有效期为3年（D错）的是《麻醉药品、第一类精神药品购用印鉴卡》。《麻醉药品、第一类精神药品购用印鉴卡》有效期为3年。